以上辅料中，属于阳离子型表面活性剂的是
A. 十二烷基硫酸钠
B. 聚山梨酯80
C. 苯扎溴铵
D. 卵磷脂
E. 二甲基亚砜

正确答案：C。苯扎溴铵

解析：本题考查表面活性剂。苯扎溴铵（C对）属于阳离子表面活性剂；十二烷基硫酸钠（A错）为阴离子型表面活性剂；聚山梨酯80（B错）为非离子型表面活性剂；卵磷脂（D错）为两性离子型表面活性剂；二甲基亚砜（E错）不属于表面活性剂。